下列哪项是宫颈癌ⅣB期的主要表现
A. 癌灶局限于宫颈（包括累及宫体）
B. 癌灶已超出宫颈，但未达盆壁
C. 癌浸润宫旁为主，已达盆壁
D. 癌浸润膀胱黏膜或直肠黏膜
E. 肿瘤远处转移

正确答案：E。肿瘤远处转移

解析：ⅣA：肿瘤侵犯邻近的盆腔器官。ⅣB：肿瘤远处转移。掌握“宫颈癌”知识点。